某女，55岁。体瘦，数月来，心烦失眠。证属心阴虚、心火旺。治当养阴、清心用的药是
A. 麦冬
B. 天冬
C. 玉竹
D. 龙眼肉
E. 莲子肉

正确答案：A。麦冬

解析：本题考查的是麦冬的功效。体瘦，数月来，心烦失眠。证属心阴虚、心火旺。治当养阴、清心用的药是麦冬（A对）。麦冬：【功效】润肺养阴，益胃生津，清心除烦，润肠通便。天冬（B错）：【功效】滋阴降火，清肺润燥，润肠通便。玉竹（C错）：【功效】滋阴润肺，生津养胃。龙眼肉（D错）：【功效】补心脾，益气血，安心神。莲子肉（E错）：【功效】补脾止泻，益肾固精，止带，养心安神。